某研究欲比较单纯肥胖者（n₁＝8）与正常人（n₂＝10）血浆总皮质醇是否不同，采用Wilcoxon两样本比较秩和检验进行分析。计算得单纯肥胖者秩和T₁＝74.5，正常人秩和T₂＝96.5，查两样本比较秩和检验T界值表：当双侧α＝0.10时，T界值范围为56～96；当双侧α＝0.05时，T界值范围为53～99；当双侧α＝0.01时，T界值范围为47～105。则P为
A. P＞0.10
B. 0.05＜P＜0.10
C. P＝0.05
D. 0.01＜P＜0.05
E. P＜0.01

正确答案：A。P＞0.10